男童，8岁。右下第一恒磨牙深龋，去除大块腐质，近髓处留少许软化牙本质，上方用Ca（OH）2盖髓后充填。下次复诊进行二次去腐质的时间是
A. 1～2周
B. 3～4周
C. 6～8周
D. 10～12周
E. 15周

正确答案：D。10～12周

解析：年轻恒牙深龋治疗时，如果估计去净腐质可能露髓时，可以采用间接牙髓治疗（二次去腐法）保留部分软化牙本质避免露髓，采取氢氧化钙间接盖髓，妥善垫底后充填。氢氧化钙制剂pH在11以上，有一定杀菌作用，可以抑制龋蚀进展，促进脱矿牙本质再矿化，刺激修复性牙本质形成。10～12周后再次治疗，去除软化牙本质，确定未露髓，再做间接盖髓，垫底，充填，此法也称二次去腐法或间接牙髓治疗法。掌握“年轻恒牙龋”知识点。